小腿三头肌中位于深层者是
A. 跟腱
B. 趾长屈肌
C. 比目鱼肌
D. 腓肠肌
E. 无

正确答案：C。比目鱼肌

解析：小腿三头肌中位于深层者是比目鱼肌（C对），腓肠肌（D错）位于小腿三头肌的浅层。